判断机体热平衡是否受到破坏最直接的指标是
A. 脉搏
B. 皮温
C. 出汗量
D. 体温
E. 温热感

正确答案：D。体温

解析：本题考查判断机体热平衡是否受到破坏最直接的指标。体温（D对ABCE错）是判断机体热平衡是否受到破坏的最直接的指标。由于人体具有较强的体温调节能力，除在很热或很冷清况下，机体的热平衡一般不易受到破坏，体温一般变化不大。